能促进维生素B₁₂吸收的物质是
A. 胃蛋白酶
B. HCl
C. 碳酸氢盐
D. 内因子
E. 黏液

正确答案：D。内因子

解析：能促进维生素B₁₂吸收的物质是内因子（D对），其与维生素B₁₂结合，形成内因子-B₁₂复合物，能保护维生素B₁₂免受肠道内消化酶的破坏，并通过回肠黏膜上特异受体的介导，促进维生素B₁₂在回肠远端的重吸收。胃蛋白酶（A错）主要促进蛋白质的消化。胃液中的HCl（盐酸）（B错）可以使蛋白质变性，并且引起胃肠激素的释放。碳酸氢盐（C错）主要与黏液（E错）构成黏液-碳酸氢盐屏障，它能有效地保护胃黏膜免受胃内盐酸和胃蛋白酶的损伤。